CO₂在血液中最主要的运输形式是
A. 去氧血红蛋白
B. 氨基甲酰血红蛋白
C. 物理溶解
D. 碳酸氢盐
E. 氧合血红蛋白

正确答案：D。碳酸氢盐

解析：血液中所含的CO₂约5%以物理溶解（C错）的形式运输，其余约95%则以化学结合的形式运输。化学结合的形式主要是碳酸氢盐(约88%）（D对）和氨基甲酰血红蛋白(约7%）（B错）。血红蛋白（AE错）为O₂的主要的运输形式。